治疗细菌性结膜炎宜选用
A. 左氧氟沙星滴眼液
B. 复方托吡卡胺滴眼液
C. 毛果芸香碱滴眼液
D. 碘苷滴眼液
E. 阿昔洛韦滴眼液

正确答案：A。左氧氟沙星滴眼液

解析：本题考查左氧氟沙星。治疗细菌性结膜炎宜选用左氧氟沙星（A对）。复方托吡卡胺（B错）是散瞳药，常用于眼底检查。毛果芸香碱（C错）是拟M胆碱药，可用于闭角型青光眼及开角型青光眼。碘苷（D错）主要用于单纯疱疹性角膜炎及其它疱疹性眼病，阿昔洛韦（E错）主要用于单纯疱疹性角膜炎。